结肠带、结肠袋、肠脂垂存在于
A. 大肠全长
B. 直肠
C. 阑尾
D. 结肠
E. 结肠和盲肠

正确答案：E。结肠和盲肠

解析：结肠带、结肠袋和肠脂垂为结肠和盲肠(E对)的特征性结构。